神经冲动到达末梢时，引起神经递质释放的离子流是
A. Cl⁻外流
B. K⁺外流
C. Ca²⁺内流
D. Cl⁻内流
E. Na⁺内流

正确答案：C。Ca²⁺内流

解析：神经冲动到达末梢，接头前膜去极化，电压门控钙通道开放，Ca²⁺内流入运动神经末梢，突触囊泡出胞、ACh释放。因此引起ACH释放的离子流是Ca²⁺内流（C对）。